说“肺为娇脏”的主要依据是
A. 肺主一身之气
B. 肺外合皮毛
C. 肺朝百脉
D. 肺为水之上源
E. 肺气通于天，不耐寒热

正确答案：E。肺气通于天，不耐寒热

解析：肺为娇脏，指肺清虚娇嫩，易受邪袭的生理特性。肺体清虚，不耐寒热，不容异物；肺主呼吸，外合皮毛，在窍为鼻，与外界相通，外感六淫之邪从皮毛或口鼻而入，常易犯肺而为病（E对）；其他脏腑病变，亦常累及于肺。肺主一身之气是指肺主司一身之气的生成和运行的功能（A错）。皮毛为一身之表，具有防御外邪，调节津液代谢与体温，以及辅助呼吸的作用；肺与皮毛之间存在着相互为用关系，故称“肺合皮毛”（B错）。肺朝百脉，指全身的血液，都要通过经脉而会聚于肺，经肺的呼吸进行气体交换，而后输布于全身，即肺气助心行血的生理功能（C错）。肺为水之上源是肺主通调水道功能的体现。肺为华盖，在五脏六腑中位置最高，参与调节全身的津液代谢，故称“肺为水之上源”（D错）。